感染性休克首先考虑的治疗措施是
A. 静脉输注血管收缩药物
B. 补充血容量，同时立即剖腹探查
C. 迅速补充血容量，同时大剂量应用抗生素
D. 静脉输注糖皮质激素
E. 滴注利尿剂改善肾功能

正确答案：C。迅速补充血容量，同时大剂量应用抗生素

解析：感染性休克首先考虑的治疗措施是迅速补充血容量，同时大剂量应用抗生素（C对B错）。心血管活性药物的应用：经补充血容量、纠正酸中毒等治疗而休克未见好转时，则应使用血管扩张药物治疗。有时还可联合应用以α受体兴奋为主，兼有轻度兴奋β受体的血管收缩剂（A错）和兼有兴奋β受体作用的α受体阻滞剂，以抵消血管收缩作用，并保持和增强β受体兴奋作用，而又不至于造成心率增快，例如山莨菪碱、多巴胺等或者联合应用间羟胺、去甲肾上腺素，或去甲肾上腺素和酚妥拉明等联合应用。皮质激素治疗糖皮质激素能抑制多种炎症介质的释放和稳定溶酶体膜，缓解SIRS，但仅限于早期、大量使用（D错），可达正常用量的10～20倍，一般不宜超过48小时。否则有发生应急性胃黏膜损伤和免疫抑制等严重并发症的危险。一般后期肾脏功能损伤才用滴注利尿剂改善肾功能（E错）。